具有降压作用的中效利尿药是
A. 阿米洛利
B. 氢氯噻嗪
C. 呋塞米
D. 氨苯蝶啶
E. 螺内酯

正确答案：B。氢氯噻嗪

解析：本题考查氢氯噻嗪的作用。具有降压作用的中效利尿药是氢氯噻嗪（B对）。氢氯噻嗪为中效能利尿药，是一类口服利尿药和降压药，其药理作用包括利尿作用、抗利尿作用和降压作用。阿米洛利（A错）、氨苯蝶啶（D错）、螺内酯（E错）是低效能利尿药。呋塞米（C错）是高效利尿药。